氨的去路主要是在肝中合成
A. 非必需氨基酸
B. 必需氨基酸
C. NH4+随尿排出
D. 尿素
E. 嘌呤、嘧啶、核苷酸等

正确答案：D。尿素

解析：氨的去路主要是在肝中合成尿素，再由肾排出体外。掌握“氨基酸及氨的代谢”知识点。